下列药材的水试有挂甲现象的是
A. 麝香
B. 珍珠
C. 牛黄
D. 羚羊角
E. 蛤蚧

正确答案：C。牛黄

解析：本题考查的是牛黄的鉴别方法。下列药材的水试有挂甲现象的是牛黄（C对）。一些传统经验鉴别方法仍是鉴别动物类中药有效而重要的手段：手试法，如毛壳麝香（A错）手捏有弹性；麝香仁以水润湿，手搓能成团，轻揉即散，不应粘手、染手、顶指或结块。水试法，熊胆仁投于水杯中，即在水面旋转并呈现黄线下降而不扩散；牛黄水液可使指甲染黄，习称“挂甲”；火试法，如麝香仁撒于炽热坩埚中灼烧，初则迸裂，随即熔化膨胀起泡，浓香四溢，灰化后呈白色灰烬，无毛、肉焦臭，无火焰或火星；马宝粉末置于锡箔纸上加热，其粉末聚集，并发出马尿臭等。珍珠（B错）：【性状鉴别】呈类球形、卵圆形、长圆形或棒形。表面类白色、浅粉红色、浅黄绿色或浅蓝色，半透明，平滑或微有凹凸，具特有的彩色光泽。羚羊角（D错）：【性状鉴别】嫩枝对光透视有“血丝”或紫黑色斑纹。除顶端部分外，有10～16个隆起环脊，用手握之，四指正好嵌入凹处。角基部横截面类圆形，内有坚硬质重的角柱，习称“骨塞”。除去“骨塞”后，角的下半部呈空洞，全角呈半透明，对光透视，上半段中央有一条隐约可辨的细孔道直通角头，习称“通天眼”。蛤蚧（E错）：【性状鉴别】头略呈扁三角形。背部灰黑色或银灰色，有黄白色或灰绿色斑点或橙红色斑点散在或密集成不显著的斑纹。四足均有5趾。全身密被圆形或多角形微有光泽的细鳞。